镇静催眠药佐匹克隆的禁忌症是
A. 低蛋白血症
B. 癫痫
C. 糖尿病
D. 重症肌无力
E. 慢性肾脏病

正确答案：D。重症肌无力

解析：本题考查佐匹克隆。镇静催眠药佐匹克隆禁用于重症肌无力（D对）患者；因其具有肌肉松弛作用，重症肌无力患者禁用。